颌骨骨折的复位标准是
A. 骨性愈合
B. 纤维性愈合
C. 骨折线上的牙齿不松动
D. 恢复原有咬合关系
E. 无感染发生

正确答案：D。恢复原有咬合关系

解析：颌骨骨折的复位标准是恢复患者原有的咬合关系。根据不同的骨折情况，可选用不同的复位方法。掌握“牙槽突骨折、颌骨骨折”知识点。